外周血中T细胞绝对数达成人水平的年龄期是
A. 新生儿期
B. 婴儿期
C. 幼儿期
D. 学龄前期
E. 学龄期

正确答案：B。婴儿期

解析：足月新生儿外周血中T细胞绝对数就可达成人水平。但因出生时外周淋巴细胞数目较少，而成熟T细胞的计数又是由外周血淋巴细胞计数来反映的，所以在新生儿期外周血中T细胞绝对数也较少（A错），在婴儿期（从出生到满1周岁以前的一段时期）可达成人水平（B对）。